上鼻甲属于何骨
A. 蝶骨
B. 上颌骨
C. 额骨
D. 筛骨
E. 泪骨

正确答案：D。筛骨

解析：筛骨迷路内侧壁附有两个卷曲小骨片，称上鼻甲和中鼻甲（D对）。